某男，35岁。春节期间突患急性胆囊炎，症见胁痛，口苦，舌红苔黄。证属肝胆湿热，医师依据其要求，给其处以方便服用的消炎利胆颗粒。药师在发药时询问患者是否患有心脏病和高血压，若是，则需要慎服该成药。因为急支糖浆内含
A. 紫菀
B. 麻黄
C. 四季春
D. 鱼腥草
E. 金荞麦

正确答案：B。麻黄

解析：本题考查的是急支糖浆的注意事项。春节期间突患急性胆囊炎，症见胁痛，口苦，舌红苔黄。证属肝胆湿热，医师依据其要求，给其处以方便服用的消炎利胆颗粒。药师在发药时询问患者是否患有心脏病和高血压，若是，则需要慎服该成药。因为急支糖浆内含麻黄（B对）。急支糖浆：【药物组成】鱼腥草（D错）、金荞麦（E错）、四季青（C错）、麻黄、前胡、紫菀（A错）、枳壳、甘草。【注意事项】孕妇及寒证者慎用。因其含麻黄，故运动员、心脏病患者、高血压病患者慎用。服药期间，忌食辛辣、生冷、油腻食物，忌吸烟饮酒。